妇科疾病的发生，主要涉及的脏腑是
A. 肾肝脾
B. 脾肺肾
C. 心肺肾
D. 心肝肾
E. 肺脾心

正确答案：A。肾肝脾

解析：脏腑生理功能的紊乱和脏腑气血阴阳的失调均可导致妇产科疾病，其 中关系最密切的是肾、肝、脾。先天不足，房劳，久病都可以导致肾虚影响冲任；肝藏血，主疏泄，体阴而用阳，妇人以血为本，经、孕、产、乳均以血为用；脾主运化，为气血生化之源，后天之本，脾主升，有统摄之功，若素体虚弱，饮食不节，思虑过度，都可导致脾虚而产生妇科疾病（A对）。